肺主气的功能与特性取决于
A. 司呼吸
B. 宗气的生成
C. 全身气机的调节
D. 朝百脉
E. 主治节

正确答案：A。司呼吸

解析：本题考查肺主气的功能与特性的决定因素，属于理解记忆内容。 肺主一身之气和呼吸之气，实际上都基于肺的呼吸功能（A对）。肺的呼吸调匀是气的生成和气机调畅的根本条件。如果肺的呼吸功能失常，势必影响一身之气的生成和运行。肺主气是宗气的来源之一，所以肺主气的功能与特性不取决于宗气的生成（B错）。肺主一身之气的运行，体现于对全身气机的调节作用（C错），肺朝百脉，是指全身的血液都通过百脉流经于肺，经肺的呼吸，进行体内外清浊之气的交换，然后再通过肺气宣降作用，将富有清气的血液通过百脉输送到全身（D错）。肺主治节，是指肺气具有治理调节肺之呼吸及全身之气、血、水的作用（E错）。